山莨菪碱适于治疗的疾病是
A. 青光眼
B. 晕动病
C. 感染中毒性休克
D. 麻醉前给药
E. 震颤麻痹

正确答案：C。感染中毒性休克

解析：山莨菪碱属于胆碱受体阻断药，可选择性对抗外周胆碱的作用，解除平滑肌痉挛，毒副作用较低，可用于胃肠绞痛，同时还能解除小血管痉挛，抑制血小板聚集，有较强的改善微循环作用，因而用于各种感染中毒性休克（C对）。胆碱受体阻断剂不能用于青光眼治疗，其中阿托品还可引起前房角间隙变窄，防水回流受阻，眼内压升高而加重青光眼（A错）。东莨菪碱具有很强的中枢抗胆碱作用，临床可用于晕动病（B错），防晕止吐。阿托品可抑制平滑肌收缩以及腺体分泌，临床可用于麻醉前给药（D错），防止分泌物阻塞呼吸道而引起窒息或吸入性肺炎。东莨菪碱、阿托品等最初可用于治疗震颤麻痹，但由于外周抗胆碱副作用的，现已主要使用合成的中枢性M胆碱受体阻断药苯海索、苯扎托品等，山莨菪碱极性大，中枢作用弱，不用于震颤麻痹（E错）。